流行性感冒病毒中哪种病毒型别除存在于人外，还存在于动物中
A. A型
B. B型
C. C型
D. A型及B型
E. B型及C型

正确答案：A。A型